以牙槽骨水平吸收为主的牙周炎是
A. 复合性牙周炎
B. 晚期成人牙周炎
C. 青少年牙周炎
D. 快速进展性牙周炎
E. 牙周脓肿

正确答案：B。晚期成人牙周炎

解析：本题考查以牙槽骨水平吸收为主的牙周炎。成人牙周炎病程进展缓慢，牙槽骨吸收缓慢，以水平型吸收为主，晚期成人牙周炎（B对）时牙槽骨表现为明显的水平吸收。复合性牙周炎（A错）指单纯性成人牙周炎伴有明显的（牙合）创伤，（牙合）创伤使牙槽骨的吸收呈多种多样，主要为垂直型骨吸收。青少年牙周炎（C错）牙槽骨吸收多局限于第一磨牙和切牙，第一磨牙的邻面有垂直型骨吸收，若近远中均有垂直型骨吸收则形成弧形吸收。快速进展性牙周炎（D错）的牙槽骨常快速吸收，既有垂直吸收，也有水平吸收。牙周脓肿（E错）是牙周炎的伴发病变，不能决定牙槽骨的吸收方式。